流行性乙型脑炎病毒属
A. 黄病毒科
B. 棒状病毒科
C. 布尼亚病毒科
D. 逆转录病毒科
E. 副黏液病毒科

正确答案：A。黄病毒科

解析：乙型脑炎病毒属虫媒病毒乙组的黄病毒科（A对）。棒状病毒科，又名枝状病毒科，是双链去氧核糖核酸病毒的一种（B错）。肾综合征出血热，又称流行性出血热，是由汉坦病毒引起的一种急性自然疫源性疾病，主要传染源是鼠类。汉坦病毒属布尼亚病毒科（C错）。HIV属于反转录病毒科人类慢病毒属（D错）。麻疹病毒属于副黏病毒科麻疹病毒（E错）。